黎明现象的原因是
A. 晚餐碳水化合物摄入过多
B. 夜间曾发生过低血糖
C. 夜间肝脏葡萄糖产生过多
D. 清晨胰岛素作用不足
E. 清晨胰岛素拮抗激素增多

正确答案：E。清晨胰岛素拮抗激素增多

解析：黎明现象是指糖尿病患者在夜间血糖控制平稳，亦无低血糖的情况下，在清晨时胰岛素拮抗激素分泌增多（E对）所引起的一种清晨高血糖状态。夜间曾发生过低血糖（B错）为Somogyi效应的原因。